有细胞壁呈球形、小而致密，是发育成熟的衣原体，经吉姆萨染色呈紫蓝色或马氏法染色呈红色，具有高度感染性的是
A. 原体
B. 始体
C. 内基小体
D. 革兰阳性圆形体
E. 革兰阴性圆形体

正确答案：A。原体

解析：原体，有细胞壁呈球形、小而致密，是发育成熟的衣原体，经吉姆萨（Giemsa）染色呈紫蓝色或马（Macchiavello）氏法染色呈红色。原体在宿主细胞外较为稳定，具有高度感染性。掌握“衣原体”知识点。